可用作栓剂基质的有
A. 聚乙二醇6000
B. 甘油明胶
C. 氮酮
D. 海藻酸
E. 没食子酸

正确答案：A、B。聚乙二醇6000；甘油明胶

解析：本题考查栓剂的基质。可用作栓剂基质的有聚乙二醇6000（A对）、甘油明胶（B对）。栓剂的基质：栓剂的基质要求：①室温时具有适宜的硬度和韧性，塞入腔道时不变形、不碎裂。在体温下易软化、熔融或溶解。②与药物无配伍禁忌，无毒性、无过敏性及黏膜刺激性，不影响药物的含量测定。③熔点与凝固点相距较近，且有润湿与乳化能力，能混入较多的水。④在贮藏过程中不易霉变，且理化性质稳定。1.油脂性基质：可可豆脂、半合成脂肪酸甘油酯类。2.水溶性基质：甘油明胶、聚乙二醇类。外用制剂附加剂：基质中添加表面活性剂、透皮促进剂（如月桂氮酮（C错））等能增加药物的穿透性，有利于吸收。凝胶剂基质属单相分散系统，有水性与油性之分。水性凝胶基质一般由水、甘油或丙二醇与纤维素衍生物、卡波姆和海藻酸盐（D错）、西黄蓍胶、明胶、淀粉等构成；油性凝胶基质由液状石蜡与聚乙烯或脂肪油与胶体硅或铝皂、锌皂等构成。没食子酸鞣质：这类鞣质水解后可产生没食子酸（E错）（或其缩合物）和多元醇。